患者，男，13岁，因发热、咳嗽2天就诊，以“肺部感染”收治入院。经验性抗感染治疗3天后，病原体培养+体外药敏试验结果显示肺炎衣原体感染。首选的目标性抗感染药物是
A. 阿奇霉素
B. 克林霉素
C. 莫西沙星
D. 依替米星
E. 阿莫西林

正确答案：A。阿奇霉素

解析：本题考查社区获得性肺炎常见病原体目标治疗。肺炎衣原体感染首选阿奇霉素（A对）500mg po qd×1d，250mg po qd×4d或者阿奇霉素500mg po qd×3d。